抑制肿瘤作用机制不涉及抗氧化的是
A. 维生素C
B. 维生素D
C. β-胡萝卜素
D. 维生素E
E. 维生素A

正确答案：B。维生素D

解析：本题考查具有抗氧化活性的维生素。抑制肿瘤作用机制涉及抗氧化的是维生素C（A对）、β-胡萝卜素（C对）、维生素E（D对）、维生素A（E对）。维生素D（B错，为本题正确答案）抑制肿瘤作用的可能机制是：抑制肿瘤细胞增殖；通过钙的作用，抑制肠道胆汁酸及其衍生物的促癌作用。